以下药物的鉴别试验是:硫喷妥钠
A. 加碘试液，试液的棕黄色消失
B. 加硫酸与亚硝酸钠，即显橙黄色，随即转为橙红色
C. 加氢氧化钠试液溶解后，加醋酸铅试液，生成白色沉淀，加热后，沉淀转为黑色
D. 加硫酸铜试液，即生成草绿色沉淀
E. 加三氯化铁试液，显紫色

正确答案：A。加碘试液，试液的棕黄色消失